血浆PaC02代偿的最高值为
A. 65mmHg
B. 55mmHg
C. 60mmHg
D. 70mmHg
E. 75mmHg

正确答案：B。55mmHg

解析：随着肺泡通气量减少，Pa02降低可通过对呼吸的兴奋作用，限制PaC02过度升高，所以血浆PaC02代偿的最高值为55mmHg（B对）。